最常见的子宫肌瘤类型是
A. 肌壁间肌瘤
B. 浆膜下肌瘤
C. 粘膜下肌瘤
D. 宫颈肌瘤
E. 阔韧带肌瘤

正确答案：A。肌壁间肌瘤

解析：按肌瘤与子宫肌壁的关系分为3类，最常见的子宫肌瘤类型是肌壁间肌瘤（A对），占60%～70%；其次为浆膜下肌瘤（B错）占20%，若肌瘤位于宫体侧壁向宫旁生长突出于阔韧带两叶之间，称为阔韧带肌瘤（E错）；再次为黏膜下肌瘤（C错）占10%～15%。（2）按肌瘤生长部位可分为宫体肌瘤（90%）和宫颈肌瘤（10%）（D错）。